右侧额部皮肤的痛觉传导与下述哪个结构有关
A. 右侧上颌神经
B. 右侧三叉神经脑桥核
C. 右侧三叉丘系
D. 左侧三叉神经脊束
E. 左侧内囊后脚

正确答案：E。左侧内囊后脚

解析：额部皮肤的痛觉传导与头面部的痛温觉和触压觉传导通路有关，该通路的第一级神经元为三叉神经节内假单极神经元。第2级神经元的胞体在三叉神经脊束核和三叉神经脑桥核，它们发出的纤维交叉到对侧。第3级神经元的胞体经内囊后脚终于背侧丘脑的腹后内侧核。因为第2级神经元的胞体在三叉神经脊束核和三叉神经脑桥核交叉到对侧，所以右侧额部皮肤的痛觉传导经左侧内囊后脚传入（E对）。